应首先考虑切除子宫止血的是
A. 宫缩乏力
B. 胎盘黏连
C. 胎盘大部植入
D. 凝血功能障碍
E. 子宫胎盘卒中

正确答案：C。胎盘大部植入

解析：胎盘大部植入（C对）是切除子宫的指征之一，需要注意的是，胎盘全部植入可无活动性出血或出血较少，此时应切忌强行剥离胎盘而造成大量出血，最安全的处理是切除子宫。（P214）子宫压缩缝合术适用于宫缩乏力（A错）性出血。胎盘黏连（八年制妇产科学第二版P116）（B错）处理需徒手剥离胎盘（B错）。凝血功能障碍（D错）正确的处理是：补充血容量和凝血因子，应用肝素和进行抗纤溶治疗。子宫胎盘卒中（P130）（E错）发生于胎盘早剥内出血急剧增多时，应当立即纠正休克、及时终止妊娠、控制DIC、减少并发症。